脊髓被膜的最外层
A. 软脊膜
B. 蛛网膜
C. 硬脊膜
D. 硬膜外隙
E. 硬膜下隙

正确答案：C。硬脊膜

解析：脊髓被膜的最外层是硬脊膜（C对）。软脊膜位于脊髓被膜的最内层（A错）。蛛网膜（B错）位于硬脊膜和软脊膜之间。硬膜外隙（D错）是硬脊膜与椎管内面的骨膜之间的间隙。硬膜下隙（E错）是硬脊膜与蛛网膜之间的潜在间隙。